可用于治疗蛔虫病、蛲虫病、钩虫病和鞭虫病的广谱驱虫药物是
A. 甲硝唑
B. 氯硝柳胺
C. 乙胺嗪
D. 甲苯咪唑
E. 三氯苯达唑

正确答案：D。甲苯咪唑

解析：本题考查甲苯咪唑。可用于治疗蛔虫病、蛲虫病、钩虫病和鞭虫病的广谱驱虫药物是甲苯咪唑（D对）。甲苯咪唑抗虫谱广，对多种肠道寄生虫如蛔虫、钩虫、蛲虫、鞭虫、绦虫以及肠道粪类圆线虫感染都具有显著疗效，对成虫和幼虫均有杀灭作用，甚至对丝虫和囊虫也有一定疗效。甲硝唑（A错）可作为阴道滴虫病的首选药。氯硝柳胺（B错）可用于治疗绦虫感染。乙胺嗪（C错）用于治疗班氏丝虫、马来丝虫和罗阿丝虫感染，也用于盘尾丝虫病。对前三者一次或多次治疗后可根治，但对盘尾丝虫病，因本品不能杀死成虫，故不能根治，亦可用于热带嗜酸红细胞增多症患者。对蛔虫感染也有效，但已为其它更安全、有效、新的抗蠕虫药所取代。三氯苯达唑（E错）用于治疗牛、羊肝片吸虫病。